男性，20岁，烧伤10分钟来院，神志清楚，面色苍白，右大腿外侧可见3cm长创口，无出血，肢体无反常活动，血压90/60mmHg，脉搏122次/分，呼吸28次/分。病人自觉腹胀，排气一次，不恰当的急诊处置是
A. 生命体征监护
B. 右大腿X光摄片检查
C. 腹部B超声检查
D. 建立静脉输液通道
E. 立位胸腹部透视检查

正确答案：B。右大腿X光摄片检查

解析：患者右大腿外侧可见3cm长创口，但无出血，且肢体无反常活动，因此不必立即行右大腿X光摄片检查（B错，为本题正确答案）；患者烧伤后入院时神志清楚，面色苍白，血压90/60mmHg（收缩压≤90mmHg）提示休克可能，此时应进行生命体征监护（A对），常规建立静脉输液通道（D对）。患者自觉腹胀，排气一次，有必要排除腹部疾病，因此需急诊行腹部B超声检查（C对）和立位胸腹部透视检查（E对）。